桑菊饮适用于小儿哪种证型的咳嗽
A. 痰湿
B. 阴虚
C. 风热
D. 痰热
E. 风寒

正确答案：C。风热

解析：桑菊饮其功用为疏风清热，宣肺止咳，故适用风热证型的急性支气管炎引起的咳嗽（C对）。痰湿型咳嗽可选用二陈汤、平胃散或三子养亲汤（A错）。阴虚型咳嗽可选用沙参麦冬汤（B错）。痰热型咳嗽可选用清金化痰汤（D错）。风寒型咳嗽可选用杏苏散或金沸草散（E错）。